下列误差中属于偶然误差的是
A. 指示剂不合适引入的误差
B. 滴定反应不完全引入的误差
C. 试剂纯度不符合要求引入误差
D. 温度波动引入的误差
E. 未按仪器使用说明正确操作引入的误差

正确答案：D。温度波动引入的误差